生长因子作用的直接靶点是
A. 进入体内的致病菌
B. 细胞膜表面的相应受体
C. 血液中的各种激素
D. 细胞分裂时的染色体
E. 代谢途径中的关键酶

正确答案：B。细胞膜表面的相应受体

解析：生长因子具有刺激细胞生长的活性，包括表皮生长因子、血小板源生长因子、成纤维细胞生长因子、肝细胞生长因子和胰岛素等，能调节细胞的各类活动与功能，通常充当细胞间的信号分子。直接靶点是细胞膜表面的相应受体（B对）。